患者女、40岁，双侧腮腺区反复肿大，伴有双眼异物感、无泪、口干、饮水量增加。检查发现：双侧腮腺肿大、质软、无压痛；张口度正常，腮腺导管口无红肿，挤压出清亮液、无脓血、口腔黏膜干燥、发红。腮腺导管口无红肿，挤压出清亮液，为明确诊断，需进一步做一系列检查，其中对诊断帮助不大的是
A. Schirmer试验
B. 腮腺造影
C. 唇腺活检
D. 腮腺平片
E. 空腹血糖

正确答案：D。腮腺平片

解析：患者女、40岁，双侧腮腺区反复肿大，伴有双眼异物感、无泪、口干、饮水量增加。检查发现：双侧腮腺肿大、质软、无压痛；张口度正常，腮腺导管口无红肿，挤压出清亮液、无脓血、口腔黏膜干燥、发红。腮腺导管口无红肿，挤压出清亮液，为明确诊断，需进一步做一系列检查，其中对诊断帮助不大的是腮腺平片（D错，为本题的正确答案）。患者疑似舍格伦综合症，可通过施墨试验以及唇腺活检（AC对），舍格伦腮腺造影可显示主导管扩张不整、边缘粗糙、呈葱皮样或花边样改变（B对），空腹血糖检查糖尿病（E对），以明确引起该疾病的可能病因；腮腺平片只能显示占位性病变，其他无法显示。